以PEG为基质的对乙酰氨基酚层表面的鲸蜡醇的作用是
A. 促进药物释放
B. 保持栓剂硬度
C. 减轻用药刺激
D. 增加栓剂的稳定性
E. 软化基质

正确答案：C。减轻用药刺激

解析：本题考查栓剂中附加剂的作用。以PEG为基质的对乙酰氨基酚层表面的鲸蜡醇的作用是减轻刺激（C对）。